依照《药品经营质量管理规范》，药品经营企业首营品种系指
A. 国内首次进口的药品
B. 国内首次生产上市的药品
C. 当地首次上市的药品
D. 本企业向某一药品生产企业首次购进的药品
E. 本企业首次出口的药品

正确答案：D。本企业向某一药品生产企业首次购进的药品

解析：本题考查药品经营相关术语。依照《药品经营质量管理规范》，药品经营企业首营品种系指本企业向某一药品生产企业首次购进的药品（D对）。《药品经营质量管理规范》第四章附则第一百七十八条：本规范下列术语的含义是：（一）在职：与企业确定劳动关系的在册人员。（二）在岗：相关岗位人员在工作时间内在规定的岗位履行职责。（三）首营企业：采购药品时，与本企业首次发生供需关系的药品生产或者经营企业。（四）首营品种：本企业首次采购的药品。（五）原印章：企业在购销活动中，为证明企业身份在相关文件或者凭证上加盖的企业公章、发票专用章、质量管理专用章、药品出库专用章的原始印记，不能是印刷、影印、复印等复制后的印记。（六）待验：对到货、销后退回的药品采用有效的方式进行隔离或者区分，在入库前等待质量验收的状态。（七）零货：拆除了用于运输、储藏包装的药品。（八）拼箱发货：将零货药品集中拼装至同一包装箱内发货的方式。（九）拆零销售：将最小包装拆分销售的方式。（十）国家有专门管理要求的药品：国家对蛋白同化制剂、肽类激素、含特殊药品复方制剂等品种实施特殊监管措施的药品。